患者，男，45岁。心悸10天，心电图示多个导联提前出现宽大畸形QRS波群，其前无相关P波，其后T波与QRS波群主波方向相反，代偿间歇完全其诊断是
A. 房性早搏
B. 房室交界性早搏
C. 室性早搏
D. 房室传导阻滞
E. 室内传导阻滞

正确答案：C。室性早搏

解析：患者出现心电图显示提前发生QRS波群，宽阔畸形，ST段与T波的方向与QRS波群主波方向相反，符合室性早搏诊断（C对）。心房的异位起搏点提早发放冲动引起的心脏搏动，称为房性期前收缩也称房性早搏。其特点为（1）提前出现的房性P'波，其形态与窦性P波不同。（2）房性P'波后的QRS波群，形态似窦性，P'R间期≥0.12s。（3）代偿间歇多不完全（A错）。房室交界区的异位起搏点提早发放冲动引起的心脏搏动，称为交界性期前收缩，也称交界性早搏。心电图表现为（1）提前出现的QRS波群，形态基本正常。也可因伴心室内差异传导而增宽。（2）提早出现的QRS波群之前或之后可有逆行P'波，也可见不到逆行P'波。逆行P'波与QRS波群的关系取决于激动传入心房、心室时的速度。激动先上传至心房，则逆行P'波在QRS波群之前，P'R间期<0.12；激动先下传至心室，则逆行P'波在QRS波群之后，RP'间期<0.20s；激动同时传至心房与心室，心房与心室同时除极，则逆行P'波可被QRS波群掩盖，或逆传心房被阻滞，则无P波（B错）。一度房室传导阻滞是指从心房到心室的电激动传导速度减慢，心电图表现为PR间期延长超过0.20s，但是每个心房激动都能传导至心室。二度房室传导阻滞又分为I型（文氏或称莫氏I型）和II型（莫氏II型）。二度I型房室传导阻滞是最常见的二度房室传导阻滞类型，是指从心房到心室的传导时间逐渐延长，直到有一个心房的激动不能传递到心室。二度II型房室传导阻滞是指心房的激动突然阻滞不能下传至心室，心电图表现为QRS波群有间期性脱漏。三度房室传导阻滞又称完全性房室传导阻滞，是指全部的心房激动都不能传导至心室，其特征为心房与心室的活动各自独立、互不相干；且心房率快于心室率（D错）。室内传导阻滞心电图主要表现为：（1）QRS波群形态改变：V、V。导联呈rsR'型（M形）或呈宽而有切迹的R波，无Q波，此为最具特征性的改变；aVR导联呈qR型或QR型，R波宽而有切迹；I、aVL、V、V。导联S波宽而有切迹，时间≥0.04 s。（2）QRS波群时间≥0.12s，V；导联R峰时间≥0.05s。（3）继发性ST-T改变：V、V。导联ST段下移，T波倒置（E错）。